关于利奈唑胺作用特点的说法正确的有
A. 利奈唑胺可用于治疗金黄色葡萄球菌引起的院内获得性肺炎
B. 利奈唑胺的作用机制为抑制细菌核酸的合成
C. 利奈唑胺可用于耐万古霉素的屎肠球菌引起的感染
D. 利奈唑胺是可逆、非选择性单氨氧化酶抑制剂
E. 利奈唑胺用药时间超过一周，可能会出现血小板减少症，需进行全血细胞计数检查

正确答案：A、C、E。利奈唑胺可用于治疗金黄色葡萄球菌引起的院内获得性肺炎；利奈唑胺可用于耐万古霉素的屎肠球菌引起的感染；利奈唑胺用药时间超过一周，可能会出现血小板减少症，需进行全血细胞计数检查

解析：本题考查利奈唑胺的作用特点。利奈唑胺作用特点的说法正确的有：利奈唑胺可用于治疗金黄色葡萄球菌引起的院内获得性肺炎（A对）。利奈唑胺可用于耐万古霉素的屎肠球菌引起的感染（C对）。利奈唑胺用药时间超过一周，可能会出现血小板减少症，需进行全血细胞计数检查（E对）。利奈唑胺适用于敏感菌所致的感染：（1）耐万古霉素的屎肠球菌引起的感染，包括并发的菌血症。（2）致病菌为金黄色葡萄球菌（甲氧西林敏感或耐甲氧西林的菌株）或肺炎链球菌（包括多重耐药菌株）引起的医院获得性肺炎。（3）金黄色葡萄球菌（甲氧西林敏感或耐甲氧西林的菌株）、化脓链球菌或无乳链菌引起的复杂性皮肤或皮肤软组织感染，包括未并发骨髓炎的糖尿病足部感染。（4）金黄色葡萄球菌（仅为甲氧西林敏感的菌株）或化脓链球菌引起的非复杂性皮肤或皮肤软组织感染。（5）由肺炎链球菌（包括对多药耐药的菌株）、由金黄色葡萄球菌（仅为甲氧西林敏感的菌株）所致的社区获得性肺炎及伴发的菌血症。利奈唑胺属噻唑烷酮类（D错），可用于治疗由需氧革兰阳性菌引起的感染，其体外抗菌谱还包括一些革兰阴性菌和厌氧菌。利奈唑胺的作用机制为与细菌50s亚基的23S核糖体核糖核酸上的位点结合，阻止功能性70S始动复合物的形成，从而抑制细菌蛋白质的合成（B错）。